下列选项中，不属于肿瘤靶向药物控制的是
A. 甲氨蝶呤
B. 全反式维A酸
C. HER-2
D. 硼替佐米
E. 利妥昔单抗

正确答案：A。甲氨蝶呤

解析：全反式维A酸（B对）、HER-2（C对）、硼替佐米（D对）、利妥昔单抗术肿瘤的靶向药物，甲氨蝶呤不属于肿瘤靶向药物（A错，为本题的正确答案）。